具有旋光性的药物均在【性状】项下收载有
A. 定量限
B. 最大吸收波长
C. 比旋度
D. 规格
E. 峰面积

正确答案：C。比旋度

解析：本题考查物理常数的测定方法。《中国药典》收载有物理常数的测定方法，主要有：相对密度、馏程、熔点、凝点、比旋度（C对）、折光率、黏度、吸收系数、碘值、皂化值和酸值等。